全身麻醉前给药，应选用的药物是
A. 毛果芸香碱
B. 新斯的明
C. 毒扁豆碱
D. 阿托品
E. 安定

正确答案：D。阿托品

解析：阿托品临床应用有①内脏平滑肌痉挛：适用于各种内脏绞痛②抑制腺体分泌：用于全身麻醉前给药，以减少呼吸道腺体及唾液腺的分泌（D对）③眼科：虹膜睫状体炎、检查眼底、眼光配眼镜④缓慢性心律失常⑤休克⑥有机磷酸酯类中毒。